对肝硬化诊断最有价值的病理改变是
A. 肝细胞变性和坏死
B. 肝内纤维组织增生
C. 肝细胞结节性再生
D. 胆管非化脓性炎症
E. 肝内假小叶形成

正确答案：E。肝内假小叶形成